有关脊髓灰质的描述哪个是错的
A. 前角运动细胞含有大型的α运动神经元和小型的r运动神经元
B. 脊髓的灰质可分为前角、侧角、后角和灰质连合几个部分
C. 后角胶状质是由大量的小型细胞所组成
D. 骶副交感核位于骶髓第２－４节的前角基部外侧份
E. 中间外侧核是交感神经的节前神经元胞体所在

正确答案：B。脊髓的灰质可分为前角、侧角、后角和灰质连合几个部分

解析：前角运动神经元包括大型的a-运动神经元和小型的γ-运动神经元（A对），a-运动神经元的纤维支配跨关节的梭外肌纤维，引起关节运动γ－运动神经元支配梭内肌纤维，其作用与肌张力调节有关。脊髓的灰质可分为前角、侧角、后角、灰质连合和中间带几个部分（B错，为本题正确选项）。Ⅱ层为后角胶状质，由大量密集的小型神经元组成（C对）。在S2-S4节段，VII层的外侧部有骶副交感核,是副交感神经节前神经元胞体所在的部位（D对）。中间外侧核是交感神经节前神经元胞体所在的部位，即交感神经的低级中枢（E对）。